物质在细胞膜载体的帮助下，由高浓度到低浓度，不需要消耗能量的转运方式属于
A. 易化扩散
B. 主动转运
C. 膜孔过滤
D. 膜动转运
E. 简单扩散

正确答案：A。易化扩散

解析：本题考查药物的转运方式。从高浓度向低浓度转运，需要载体，属于易化扩散（A对）。易化扩散又称中介转运，是指一些物质在细胞膜载体的帮助下，由膜的高浓度一侧向低浓度一侧转运的过程，不消耗能量。